缩宫素的禁忌证不包括
A. 产道异常
B. 胎位不正
C. 前置胎盘
D. 自然分娩
E. 头盆不称

正确答案：D。自然分娩